龋齿按病变程度的分类为
A. 原发性龋和继发性龋
B. 浅龋、中龋和深龋
C. 开放龋和隐匿龋
D. 咬合面龋和邻面龋
E. 急性、慢性和静止性龋

正确答案：B。浅龋、中龋和深龋

解析：本题考查龋病的病理变化。龋齿按病变程度的分类为浅龋、中龋和深龋（B对）。龋病按充填治疗史分为原发性龋和继发性龋（A错），按病变深度可分为浅龋、中龋和深龋，按发生的隐匿性分为开放龋和隐匿龋（C错），按发生的牙面称为咬合面龋和邻面龋（D错），按病变进展速度分为急性龋、慢性龋和静止龋（E错）。